某患者，性格比较压抑，在工作中与大家都能合作，做事很谨慎，存在情绪表达障碍，其行为类型属于
A. A型行为
B. B型行为
C. C型行为
D. D型行为
E. E型行为

正确答案：C。C型行为